经内囊膝的传导束为
A. 皮质脊髓束
B. 丘脑皮质束
C. 皮质核束
D. 视辐射
E. 内侧丘系

正确答案：C。皮质核束

解析：经内囊膝的传导束为皮质核束（C对），其由中央前回下部的锥体细胞的轴突集合而成，其细胞体位于中央前回下部，在脑干内下行，经过内囊膝部，大部分终止于两侧脑神经运动核,。